采用记账法对某幼儿园进行为期一周的膳食调查，计算每人每日各种食物的平均摄取量，需要的数据不包括
A. 调查开始时库存食物数量
B. 每日购入的食物数量
C. 烹调前后食物的生、熟重量比
D. 各餐用餐人数
E. 调查结束时剩余食物数量

正确答案：C。烹调前后食物的生、熟重量比